RR表示
A. 比值比
B. 相对危险度
C. 特异危险度
D. 人群特异危险度
E. 特异危险度百分比

正确答案：B。相对危险度

解析：本题考查相对危险度的概念。相对危险度（B对ACDE错）（RR）通常包括了危险度比或率比。危险度比是暴露组的危险度（测量指标是累积发病率）与对照组的危险度之比。率比是暴露组与对照组的发病密度之比。危险度比和率比都是反映暴露与发病（死亡）关联强度的最有用的指标。